小量毒物长期进入人体所引起的中毒称为
A. 急性中毒
B. 慢性反应
C. 亚急性中毒
D. 急性反应
E. 慢性中毒

正确答案：E。慢性中毒